适用于肾性高血压及伴有肾功能不良高血压患者的药物是
A. 普萘洛尔
B. 哌唑嗪
C. 甲基多巴
D. 氨氯地平
E. 尼群地平

正确答案：C。甲基多巴

解析：本题考查甲基多巴。适用于肾性高血压及伴有肾功能不良高血压患者的药物是甲基多巴（C对）。甲基多巴为作用于中枢神经系统的抗高血压药物，适用于中度高血压，因对肾血流、肾小球滤过影响不大，故适用于肾性高血压及伴有肾功能不良的高血压患者。普萘洛尔（A错）是β受体阻断药，α受体激动占优势，可诱发支气管痉挛，所以伴有支气管哮喘的高血压患者禁用。哌唑嗪（B错）是一种肾上腺素受体阻断药，部分患者首次用药后可出现体位性低血压、心悸、晕厥等，称为“首剂效应”。氨氯地平（D错）为1,4-二氢吡啶类钙离子拮抗剂，主要用于高血压及心绞痛治疗，不良反应较轻，主要为水肿、潮红和疲劳。